促红细胞生成素的产生部位主要是
A. 肝
B. 肾
C. 脾
D. 骨髓
E. 血液

正确答案：B。肾